《医疗事故处理条例》规定，造成患者轻度残疾器官组织损伤导致一般功能障碍的属于
A. 一级医疗事故
B. 二级医疗事故
C. 三级医疗事故
D. 四级医疗事故
E. 严重医疗差错

正确答案：C。三级医疗事故

解析：《医疗事故处理条例》总则第四条：根据对患者人身造成的损害程度，医疗事故分为四级：一级医疗事故（A错）：造成患者死亡、重度残疾的；二级医疗事故（B错）：造成患者中度残疾、器官组织损伤导致严重功能障碍的；三级医疗事故（C对）：造成患者轻度残疾、器官组织损伤导致一般功能障碍的；四级医疗事故（D错）：造成患者明显人身损害的其他后果的。严重医疗差错（E错）是指医疗过失已给病人造成了一定的不良后果的差错。后果可表现为各种方式，如增加痛苦、延长治疗时间、扩大经济支出、遗留手术瘢痕、出现不适症状、产生轻度并发症或后遗症等。